下列关于引流物的放置时间的叙述中，正确的是
A. 无效腔的引流物应放置至脓液及渗出液完全消除为止
B. 污染创口引流物多在24～48小时后去除
C. 负压引流一般在24小时内引流量少于20～30ml时去除
D. 脓肿的引流物应放置至脓液及渗出液完全消除为止
E. 以上均正确

正确答案：E。以上均正确

解析：引流物的放置时间因手术不同而异。引流物为异物，在达到引流目的后，应尽早拔除。污染创口或为防止积血、积液而放置的引流物，多在24～48小时后去除；脓肿或无效腔的引流物应放置至脓液及渗出液完全消除为止；负压引流一般在24小时内引流量少于20～30ml时去除。掌握“口外手术打结、缝合及外科引流”知识点。